发芽马铃薯中毒的有毒物质是
A. 植物血凝素
B. 类秋水仙碱
C. 3-硝基丙酸
D. 皂素
E. 龙葵素

正确答案：E。龙葵素